女，25岁。3天前受惊吓后突然不语不动，不吃不喝，肢体僵硬，口中唾液外流，不知主动吐出，晚间自己到厨房找吃的。患者2年前曾有凭空闻语、捡食垃圾等怪异行为，持续1个月好转。患者最可能的诊断是
A. 分离（转换）性障碍
B. 急性应激障碍
C. 脑器质性精神障碍
D. 精神分裂症
E. 妄想性障碍

正确答案：A。分离（转换）性障碍

解析：青年女性，3天前受惊吓后（起病前有明确的心理社会因素）突然不语（分离障碍中的缄默失声）不动，不吃不喝，肢体僵硬，口中唾液外流，不知主动吐出（木僵症状），晚间自己到厨房找吃的。患者2年前曾有凭空闻语、捡食垃圾等怪异行为（癔症性精神病），持续1个月好转。根据该患者的病史、临床表现等，最有可能的诊断是分离（转换）性障碍（A对）。急性应激障碍（B错）与应激源有明显因果关系，其临床表现和预后与应激因素密切相关。脑器质性精神障碍（C错）是中枢神经系统的器质性病变，可出现强迫症状。精神分类症（D错）主要症状有幻觉、妄想症状（出现频率最高），且精神分裂症大多为持续性病程。妄想性障碍（E错）碍的特点是妄想结构严密系统，妄想内容有一定的事实基础，不荒谬离奇，思维有条理和逻辑，行为和清感反应与妄想内容一致，无智能和人格衰退，一般没有幻觉或不为主要表现。